真热假寒适用的法则是
A. 正治法
B. 从治法
C. 逆治法
D. 补虚法
E. 反佐法

正确答案：B。从治法

解析：反治，是指顺从病证的外在假象而治的一种治疗原则。由于采用的方药性质与病证中假象的性质相同，故又称为从治。治疗真热假寒，应使用寒因寒用，用寒性药物治疗，故称为从治（B对）。正治法（A错）适用于疾病的征象与本质一致的病症。如热证用寒药，故又称“逆治”（C错）。补虚法（D错）属于虚则补之，指虚损行病证，应用补益作用的方药来治疗，以补虚治疗虚证。反佐法（E错）属于药物的配伍原则，与治法相混淆了。